心肌梗死症状中最先出现下列哪一项
A. 发热
B. 疼痛
C. 恶心呕吐
D. 呼吸困难
E. 昏厥

正确答案：B。疼痛

解析：发生心肌梗死时，患者多表现为胸骨后或心前区持续、剧烈压榨样闷痛。可有出汗、恶心、呕吐、等伴随症状，部分患者有濒死感。掌握“冠状动脉粥样硬化性心脏病”知识点。